下列关于卵圆窝的说法何者正确
A. 在室间隔右侧
B. 于胎生时期就存在
C. 在室间隔左侧
D. 在房间隔左心房面上
E. 是卵圆孔闭锁的遗迹

正确答案：E。是卵圆孔闭锁的遗迹

解析：卵圆窝位于房间隔右侧面（D错）中下部。是胚胎时期卵圆孔闭锁的遗迹（E对），此处薄弱，是房间隔缺损的好发部位。